与EB病毒感染无关的疾病是
A. 鼻咽癌
B. 淋巴组织增生性疾病
C. 宫颈癌
D. 非洲儿童恶性淋巴瘤
E. 传染性单核细胞增多症

正确答案：C。宫颈癌

解析：宫颈癌的发生主要与HPV（人乳头瘤病毒）感染有关，与EB病毒感染无关（C错，为本题正确答案）。鼻咽癌（A错）、淋巴组织增生性疾病（B错）、非洲儿童恶性淋巴瘤（D错）和传染性单核细胞增多症（E错）都与EB病毒感染有关。